女孩，1岁。未接种过卡介苗，其父患活动性肺结核，时有咯血。目前小儿与父母生活在一起，但无任何症状。小儿胸部X线片未见异常，PPD试验（+）。除隔离父亲外，宜对小儿采取的措施是
A. 口服异烟肼，疗程6～9个月
B. 继续观察，暂不作任何处理
C. 口服利福平，疗程1年
D. 口服利福平+异烟肼，疗程1年
E. 立即接种卡介苗

正确答案：A。口服异烟肼，疗程6～9个月

解析：患者为未接种卡介苗婴幼儿，其父患活动性肺结核，时有咯血。目前小儿与父母生活在一起（结核接触史），但无任何症状。小儿胸部X线片未见异常，PPD试验（+）。结合患者的症状和实验室检查，不能确诊肺结核，因患者有结核密切接触史及PDD试验阳性，宜对该患者采用预防性抗结核治疗，具体治疗为口服异烟肼，疗程6-9 个月（A对）。